喉口两侧的喉咽部为
A. 梨状隐窝
B. 咽隐窝
C. 咽鼓管咽口
D. 扁桃体窝
E. 咽峡

正确答案：A。梨状隐窝

解析：咽鼓管圆枕后方与咽后壁间有咽隐窝(B错)，梨状隐窝(A对)位于喉咽，咽鼓管咽口(C错)位于鼻咽部两侧壁上，扁桃体窝(D错)位于口咽部，咽峡(E错)为口咽与口腔的界限。